单颌全口义齿基托固位是依靠
A. 吸附力
B. 摩擦力
C. 重力
D. 粘结力
E. 地心引力

正确答案：A。吸附力

解析：单颌全口义齿的固位和稳定：单颌全口义齿依靠基托吸附力和大气压力固位，而其对颌的天然牙由牙周膜固定在牙槽骨内，如此相差悬殊的固位条件使得单颌全口义齿更容易脱位。掌握“单颌全口义齿”知识点。